男，26岁。右小腿受伤12小时。查体：右小腿中段前方皮肤有一10cm长创口，软组织挫伤严重，胫骨断端外露，双侧足背动脉搏动对称，感觉正常。彻底清创后最适宜的进一步治疗方法是
A. 螺丝钉固定
B. 髓内钉固定
C. 石膏固定
D. 钢板固定
E. 外固定架固定

正确答案：E。外固定架固定

解析：患者右小腿受伤（外伤史），右小腿中段前方皮肤有一10cm长创口（皮肤破裂），胫骨断端外露（骨膜破裂且骨折端与外界相通），结合患者病史、症状和体征，应诊断为右胫骨开放性骨折，在彻底清创后最适宜的进一步治疗方法是外固定架固定（E对），这样既可稳定骨折，又方便术后换药。螺丝钉固定（A错）、髓内钉固定（B错）、钢板固定（D错）均为内固定方法，适用于污染不重，受伤时间较短的开放性胫腓骨骨折，但该患者受伤时间长达12小时，且软组织损伤严重，不适宜进行内固定。石膏固定（C错）是治疗闭合性胫腓骨骨折的常用方法，开放性胫腓骨骨折早期使用容易造成压迫坏死。